眶下神经阻滞麻醉口外注射法，注射针进入眶下孔内，注射麻药
A. 0.3～0.5ml
B. 0.5～1ml
C. 1ml
D. 1.5～2ml
E. 2～3ml

正确答案：C。1ml

解析：眶下神经阻滞麻醉口外注射法：注射针进入眶下孔内，随即注射麻药1ml。注意注射针进入眶下管不可过深，以免伤及眼球。掌握“颌面部常用局麻法及牙拔除的麻醉选择”知识点。